药剂学的研究内容主要包括
A. 药剂学的基本理论的研究
B. 新剂型的研究
C. 新辅料的研究
D. 制剂新机械的研究
E. 医药新技术的研究

正确答案：A、B、C、D、E。药剂学的基本理论的研究；新剂型的研究；新辅料的研究；制剂新机械的研究；医药新技术的研究

解析：本题考查药剂学的研究内容。药剂学的研究内容主要包括药剂学的基本理论的研究（A对）、新剂型的研究（B对）、新辅料的研究（C对）、制剂新机械的研究（D对）、医药新技术的研究（E对）。药剂学的主要研究内容包括：基本理论的研究、新剂型、新制剂、新技术、新辅料、新设备的研究和开发。